颈内动脉主要供应
A. 脑干
B. 大脑半球前2/3
C. 小脑
D. 间脑
E. 无

正确答案：B。大脑半球前2/3

解析：大脑半球的前 2/3（B对） 和部分间脑由颈内动脉供应，大脑半球后 1/3 及部分间脑（D错）、脑干（A错）和小脑（C错）由椎动脉供应。